患者，男，65岁，因咳嗽、咳大量脓痰、呼吸困难入院，诊断为慢性阻塞性肺病急性加重。该患者临床治疗不应选用的药物是
A. 乙酰半胱氨酸
B. 氨溴索
C. 羧甲司坦
D. 右美沙芬
E. 溴己新

正确答案：D。右美沙芬

解析：本题考查右美沙芬。该患者临床治疗不应选用的药物是右美沙芬（D错，为本题正确答案）。右美沙芬主要用于干咳，适用于感冒、急性或慢性支气管炎、支气管哮喘、咽喉炎、肺结核以及其他上呼吸道感染时的咳嗽，没有祛痰作用。由题干可知，该患者咳嗽、伴大量脓痰，故不宜选用右美沙芬。乙酰半胱氨酸（A对）用于治疗浓稠粘液分泌物过多的呼吸道疾病，如急性支气管炎、慢性支气管炎及其病情恶化者、肺气肿、黏稠物阻塞症以及支气管扩张症，适宜该患者选用。氨溴索（B对）用于伴有痰液分泌不正常及排痰功能不良的急性、慢性呼吸道疾病，例如慢性支气管炎急性加重、喘息型支气管炎、支气管扩张及支气管哮喘的祛痰治疗，适宜该患者选用。羧甲司坦（C对）用于治疗慢性支气管炎、支气管哮喘等疾病引起的痰液粘稠、咳痰困难患者，适宜该患者选用。溴已新（E对）用于慢性支气管炎、哮喘等引起的粘痰不易咳出的患者，适宜该患者选用。